炮制法半夏的辅料应选用
A. 甘草、生姜
B. 甘草、生石灰
C. 生姜、明矾
D. 甘草、金银花
E. 甘草、皂角

正确答案：B。甘草、生石灰

解析：本题考查的是半夏的炮制方法。炮制法半夏的辅料应选用甘草、生石灰（B对）。半夏：【炮制方法】处方用名有生半夏、清半夏、姜半夏、法半夏。①生半夏：取原药材，除去杂质，洗净，干燥，用时捣碎。②清半夏：取净半夏，大小分开，用8%白矾溶液浸泡至内无干心，口尝微有麻舌感，取出，洗净，切厚片，干燥。每100kg净半夏，用白矾20kg。③姜半夏：取净半夏，大小分开，用水浸泡至内无干心，取出，另取生姜（C错）切片煎汤，加白矾与半夏共煮至透心，取出，晾干，或晾至半干，干燥；或切薄片，干燥。每100kg净半夏，用生姜25kg，白矾12.5kg。④法半夏：取净半夏，大小分开，用水浸泡至内无干心，取出，另取甘草适量，加水煎煮二次，合并煎液，倒入用适量石灰水配制的石灰液中，搅匀，加入上述已浸透的半夏，浸泡，每日搅拌1～2次，并保持浸液pH在12以上，至切面黄色均匀，口尝微有麻舌感时，取出，洗净，阴干或烘干。每100kg净半夏，用甘草15kg，生石灰10kg。